复方樟脑酊属于
A. 麻醉药品
B. 毒性药品
C. 两者均是
D. 两者均不是

正确答案：A。麻醉药品

解析：本题考查麻醉药品。复方樟脑酊属于麻醉药品（A对）。麻醉药品是指连续使用后易产生身体依赖性、能成瘾癖的药品。《麻醉药品品种目录（2013版）》共121个品种，其中我国生产及使用的品种及包括的制剂、提取物、提取物粉共有27个品种，具体有以下品种。1.可卡因；2.罂粟浓缩物（包括罂粟果提取物、罂粟果提取物粉）；3.二氢埃托啡；4.地芬诺酯；5.芬太尼；6.氢可酮；7.氢吗啡酮；8.美沙酮；9.吗啡（包括吗啡阿托品注射液）；10.阿片（包括复方樟脑酊、阿桔片）；11.羟考酮；12.哌替啶；13.瑞芬太尼；14.舒芬太尼；15.蒂巴因；16.可待因；17.右丙氧芬；18.双氢可待因；19.乙基吗啡；20.福尔可定；21.布桂嗪；22.罂粟壳。医疗用毒性药品（简称毒性药品）（B错）是指毒性剧烈，治疗剂量与中毒剂量相近，使用不当会致人中毒或死亡的药品。毒性药品中药品种共27种：砒石（红砒、白砒）、砒霜、水银、生马钱子、生川乌、生草乌、生白附子、生附子、生半夏、生南星、生巴豆、斑蝥、青娘虫、红娘子、生甘遂、生狼毒、生藤黄、生千金子、生天仙子、闹羊花、雪上一枝蒿、白降丹、蟾酥、洋金花、红粉、轻粉、雄黄。